当小儿出现脾胃病时，应特别注意询问的是
A. 胎产史
B. 喂养史
C. 生长发育史
D. 预防接种史
E. 家族史

正确答案：B。喂养史

解析：小儿脾常不足，饮食不自知，易为乳食所伤。喂养不当，或未按时添加辅食，或饮食偏嗜均易导致脾胃病，故小儿出现脾胃病时，应特别注意询问喂养史（B对）。